痰液镜检查到色素细胞最常见于
A. 心衰引起的肺淤血
B. 肺包囊虫病
C. 阿米巴肺脓肿
D. 支气管哮喘
E. 以上都不是

正确答案：A。心衰引起的肺淤血

解析：痰内含有色素细胞，如吞噬含铁血黄素者，多见于心功能不全所致的肺淤血（A对E错）；若吞噬炭粒者，见于炭末沉着症或吸人大量烟尘者。肺包囊虫病（B错）是细粒棘球条虫的幼虫在人体肺部引起的寄生虫病，肺部活检可见到细粒棘球条虫的幼虫。阿米巴肺脓肿（C错），大多数是由阿米巴肝脓肿穿过横膈直接蔓延而来，少数为阿米巴滋养体经血流到肺所形成。脓肿多位于右肺下叶，常为单发，由于横膈被穿破，故肺脓肿常与肝脓肿互相连通。脓肿腔内含咖啡色坏死液化物质，如破入支气管，坏死物质被排出后可形成空洞。临床上患者有类似结核的症状，咳出褐色脓样痰，其中可检见阿米巴滋养体。支气管哮喘（D错）是由多种细胞和细胞组分参与的气道慢性炎症性疾病，肺内可见较多的嗜酸性粒细胞。